乙肝20年，肝功能异常半年，HBVDNA2.8×10⁵，最重要的治疗
A. 干扰素
B. 恩替卡韦
C. 拉米夫定
D. 阿德福韦酯
E. 利巴韦林

正确答案：B。恩替卡韦

解析：此题无答案。患者乙肝20年，肝功能异常半年，HBVDNA2.8×10⁵，结合患者乙肝20年病史和辅助检查表现，本题考点：病毒性肝炎的治疗
1.急性肝炎
治疗：自限性疾病，对症支持治疗。
甲肝-粪口传播，不会出现病原携带状态。
2.慢性肝炎
治疗：
a.慢性乙肝、丙肝：干扰素
（6个月内每2月检测1次，以后3-6月测1次）
b.合并肝硬化：用核酸类似物：恩替卡韦。（前3个月每月检测1次，以后每3-6个月测1次，随访12个月）
3.暴露患者：高效价乙型肝炎免疫球蛋白（HBIG））。